PSI指数为500时，大气质量分级为
A. 良好
B. 中等
C. 不健康
D. 很不健康
E. 危险

正确答案：E。危险

解析：本题考查PSI的大气质量分级。PSI即污染物标准指数，是用于评价大气质量逐日变化的大气质量指数。PSI指数为500时，大气质量分级为危险（E对ABCD错）。